引起上消化道出血最常见的原因是
A. 胃癌
B. 胃十二指肠溃疡
C. 肝硬化
D. 出血性胃炎
E. 胆道出血

正确答案：B。胃十二指肠溃疡

解析：上消化道出血常见的原因有消化性溃疡（胃十二指肠溃疡）（B）、肝硬化所致食管胃底静脉曲张破裂（C）、出血性胃炎（D）和胃癌（A），其中消化性溃疡（胃十二指肠溃疡）（B对）是引起上消化道出血最常见的原因，大约占所有病因的50％。胆道出血（E错）也可以引起周期性上消化道出血，但较少见。